下列不作为社会医学研究任务的是
A. 研究社会卫生状况、特征及变动趋势
B. 研究高危人群的健康状况、特征
C. 找出危害人群健康的主要疾病及与社会因素的关系
D. 研究改善健康、防病、治病的技术措施

正确答案：D。研究改善健康、防病、治病的技术措施

解析：本题考查社会医学的研究任务。社会医学的研究任务包括：研究社会卫生状况、特征及变动趋势（A对）；研究高危人群的健康状况、特征（B对）；找出危害人群健康的主要疾病及与社会因素的关系（C对）等。研究改善健康、防病、治病的技术措施（D错，为本题正确答案）不属于社会医学的研究任务。